水丸易吸收空气中的水分，引起
A. 霉变
B. 虫蛀
C. 松碎
D. 黏结
E. 融化

正确答案：A、B、C。霉变；虫蛀；松碎

解析：本题考查的是丸剂的变异现象。水丸易吸收空气中的水分，引起霉变（A对）、虫蛀（B对）与松碎（C对）。水丸、糊丸：水丸、糊丸含药物原粉较多，易吸收空气中的水分，容易发生霉变、虫蛀、松碎等。宜密封置于干燥处。黏结（D错）指粘连，温度过高或受潮时片剂、胶囊剂、胶剂、栓剂可能发生粘连，应置阴凉干燥处贮存，且应注意避免挤压。容易融化（E错）的中成药剂型，2022年考试指南未明确说明。